男性，20岁。上前牙跌伤1天。口腔检查：左上1近中切角缺损，牙本质暴露，探诊酸痛，温度试验酸痛明显，无松动。X线牙片示：无根折。最佳治疗方案是
A. 用氧化锌丁香油黏固剂黏固临时塑料冠6～8周后复合树脂修复，并定期复诊
B. 即刻复合树脂修复
C. 牙髓摘除术后复合树脂修复
D. 牙髓切断术后复合树脂修复
E. 直接烤瓷全冠修复

正确答案：A。用氧化锌丁香油黏固剂黏固临时塑料冠6～8周后复合树脂修复，并定期复诊

解析：本题考查冠折的治疗。男性，20岁。上前牙跌伤1天。口腔检查：左上1近中切角缺损，牙本质暴露，探诊酸痛，温度试验酸痛明显，无松动。X线牙片示：无根折。最佳治疗方案是用氧化锌丁香油黏固剂黏固临时塑料冠6～8周后复合树脂修复，并定期复诊（A对）。患牙牙本质暴露，探诊酸痛，温度试验酸痛明显，并未露髓，应用氧化锌丁香油粘固剂粘固临时塑料冠，待6～8周有足够的修复性牙本质形成后，进行复合树脂修复（A对BE错）。冠折牙髓已暴露，且牙根发育完全的患牙，应行牙髓摘除术（C错）。冠折牙髓暴露的年轻恒牙，应根据牙髓暴露和污染的程度作活髓切断术（D错）。